前牙3/4冠邻沟的主要作用是
A. 阻止（牙合）向脱位
B. 阻止舌向脱位
C. 阻止近远中向脱位
D. 阻止唇向脱位
E. 阻止龈向移位

正确答案：B。阻止舌向脱位

解析：本题考查前牙3/4冠邻沟的主要作用。前牙3/4冠冠邻沟相当于全冠预备体的唇侧壁，主要作用是阻止冠舌向脱位（B对）。阻止（牙合）向脱位（A错）即保证3/4冠的固位，主要是通过良好的粘结和牙体预备时各轴壁相对平行来实现。3/4冠一般不易发生近远中向脱位（C错）。阻止唇向脱位（D错）是3/4冠舌侧壁的作用。阻止龈向移位（E错）是切端沟的主要作用。